下颌后部牙槽嵴的吸收方向是
A. 向下、向后
B. 向下、向外
C. 向下、向内
D. 向后、向外
E. 向下、向前

正确答案：B。向下、向外

解析：牙槽嵴吸收多少与骨质致密度直接有关，上颌牙槽嵴外侧骨板较内侧骨板疏松，外侧骨板吸收较内侧骨板多，牙槽嵴吸收的方向为向上向内。而下颌牙槽嵴内侧骨板较外侧骨板疏松，内侧骨板吸收较外侧骨板多，牙槽嵴吸收的方向为向下向外，结果上颌弓的外形逐渐缩小，下牙弓外形逐渐变大。掌握“牙列缺失后的病因及影响”知识点。